U/ml，最可能的诊断是
A. 生殖器结核
B. 子宫内膜异位症
C. 卵巢上皮性癌
D. 卵巢库肯勃瘤
E. 乙状结肠癌转移

正确答案：C。卵巢上皮性癌

解析：该患者为老年女性，腹胀伴食欲不振半年余（卵巢恶性肿瘤早期常无症状，晚期主要症状为腹胀、腹部肿块、腹腔积液及其他消化道症状），腹部膨隆，移动性浊音（﹢）（常伴腹腔积液）。妇检：宫颈光滑，盆底可触及多个质硬结节。左侧附件区可触及包块，约6cm×5cm大小，呈囊实性，界限不清（三合诊检查可在直肠子宫陷凹处触及质硬结节或肿块，肿块多为双侧，实性或囊实性，表面凹凸不平，活动差，与子宫分界不清），检查结果示CA125 1260U/ml（80%卵巢上皮性癌患者血清CA125水平升高），最可能的诊断是卵巢上皮性癌（C对）。生殖器结核（P265）（A错）的主要临床表现为不孕、月经失调、下腹坠痛及低热、乏力、盗汗等全身症状；卵巢库肯勃瘤（P331）（D错）又称印戒细胞癌，是一种特殊的卵巢转移性腺癌，原发部位在胃肠道，镜下见典型印戒细胞；乙状结肠癌转移（E错）常侵犯膀胱、子宫、输尿管，以上三种疾病均无血清CA125升高。子宫内膜异位症（P271）（B错）的主要临床表现为继发性痛经、进行性加重、不孕，双合诊检查时，可发现子宫后倾固定，一侧或双侧附件处触及囊实性包块，活动差。患者血清CA125也可升高，但很少超过200U/ml（P413）。